某药厂生产的藿香祛暑胶囊具有祛暑化湿，解表和中功效。其药物组成为广藿香、香薷、白芷、紫苏叶、苍木、丁香、陈皮、大腹皮、法半夏、茯苓、生姜、甘草，辅料为甘油、植物油、明胶、蜂蜡、食用色素。《中国药典》规定，方中陈皮的含量测定成分是
A. 橙皮苷
B. 杜鹃素
C. 葛根素
D. 木犀草苷
E. 槲皮素

正确答案：A。橙皮苷

解析：本题考查的是陈皮的含量测定成分。《中国药典》规定，方中陈皮的含量测定成分是橙皮苷（A对）。陈皮中除含挥发油外，还含有多种黄酮类化合物，其中橙皮苷多制成甲基橙皮苷供药用，是治疗冠心病药物“脉通”的重要原料之一。《中国药典》以橙皮苷为指标成分对陈皮进行含量测定。要求陈皮中橙皮苷含量不得少于3.5%；广陈皮中橙皮苷含量不得少于2.0%，对广陈皮，另外要求测定川陈皮素和橘皮素的总量，总量不得少于0.42%。杜鹃素（B错）是满山红的含量测定成分。满山红叶中含有杜鹃素、8-去甲基杜鹃素、山柰酚、槲皮素、杨梅素、金丝桃苷、异金丝桃苷以及莨菪亭、伞形酮、木毒素、牻牛儿酮、薄荷醇、杜松脑和α-桉叶醇、β-桉叶醇、γ-桉叶醇等。其中杜鹃素为祛痰成分，临床用于治疗慢性支气管炎。《中国药典》以杜鹃素为对照品对满山红进行含量测定。要求杜鹃素含量不少于0.08%。葛根素（C错）是葛根的含量测定成分。葛根含异黄酮类化合物，主要成分有大豆素、大豆苷、大豆素-7,4'-二葡萄糖苷及葛根素、葛根素-7-木糖苷。《中国药典》以葛根素为指标成分进行含量测定，要求含葛根素不得少于2.4%。木犀草苷（D错）与槲皮素（E错）是银杏黄酮质量的控制标准。银杏叶中的黄酮类化合物有黄酮、黄酮醇及其苷类、双黄酮和儿茶素类等。《中国药典》以总黄酮醇苷和萜类内酯为指标成分进行含量测定。要求总黄酮醇苷不少于0.4%，对照品采用槲皮素、山柰素和异鼠李素；要求萜类内酯不少于0.25%，对照品采用银杏内酯A、银杏内酯B、银杏内酯C和白果内酯。到目前为止，已从银杏叶中分离出20多个黄酮类化合物，其结构大体可分为山柰酚类、槲皮素类、木犀草素、二粒小麦黄酮、儿茶素类和双黄酮类。